关于利多卡因的抗心律失常作用，哪项错误
A. 是窄谱抗心律失常药
B. 能缩短普肯耶纤维的动作电位时程和有效不应期
C. 对传导速度的作用，受细胞外液K⁺浓度的影响
D. 对心肌的直接作用是抑Na⁺内流，促K⁺外流
E. 治疗剂量就能降低窦房结的自律性

正确答案：E。治疗剂量就能降低窦房结的自律性